紫外-可见分光光度计中常用的单色器是
A. 氘灯
B. 光栅
C. 比色皿
D. 光电倍增管
E. 真空热电偶

正确答案：B。光栅

解析：本题考查分光度计中所用的单色器。早期的色散原件主要是棱镜，近年来多用光栅（B对）。